不支持慢性粒细胞白血病加速期的是
A. 外周血中原始粒细胞＞5%
B. 骨髓中原始粒细胞≥10%
C. 外周血嗜碱性粒细胞＞20%
D. 不明原因的血小板进行性减少
E. 不明原因的血小板进行性增加

正确答案：A。外周血中原始粒细胞＞5%

解析：慢性粒细胞白血病加速期的特点常有发热、虚弱、进行性体重下降、骨骼疼痛，逐渐出现贫血和出血。脾持续或进行性肿大。原来治疗有效的药物无效。外周血或骨髓原始细胞≥10%（A错，为本题正确答案）（B对），外周血嗜碱性粒细胞＞20%（C对），不明原因的血小板进行性减少或增加（DE对），除Ph染色体以外又出现其他染色体异常，如+8、双Ph染色体、17号染色体长臂的等臂（i17q）等，骨髓活检显示胶原纤维显著增生。